患者，女，25岁。平素食少纳呆，体倦乏力，经常感冒。近日汗出恶风，劳累尤甚，面色少华，舌苔薄白，脉弱。其诊断是
A. 哮证，肺虚
B. 喘证，脾虚
C. 自汗，肺卫不固
D. 盗汗，阴虚火旺
E. 胸痹，气阴两虚

正确答案：C。自汗，肺卫不固

解析：根据题中提供的病例资料，其主诉为汗出恶风，劳累尤甚，故应诊断汗证之自汗。平时食少，脾气不足，母病及子，肺气也虚，卫外不固，故易受邪侵而经常感冒，时时汗出。卫外不固故汗出而恶风。动则耗气，故劳累之后汗出尤甚。面色少华，脉弱也为气虚之象，故诊断为肺卫不固证（C对）。哮证，肺虚，虚哮证证候：喉中哮鸣如鼾，声低，气短息促，动则喘甚，发作频繁（A错）。喘证是以呼吸困难，甚至张口抬肩，鼻翼扇动，不能平卧为临床特征的病证。虚喘则见肺气虚耗、肾虚不纳和正虚喘脱等证候。无喘证，脾虚之说（B错）。盗汗，寐中汗出，醒来自止者，称为盗汗，亦称为寝汗。阴虚火旺证证候：夜寐盗汗，或有自汗，五心烦热，或兼午后潮热，两颧色红，口渴，舌红少苔，脉细数（D错）。胸痹，气阴两虚证的证候是心胸隐痛，时作时休，心悸气短，动则益甚，伴倦怠乏力，声息低微，面色胱白，易汗出，舌质淡红，舌体胖且边有齿痕，苔薄白，脉虚细缓或结代。